患者，中年男性。持续或间断咳血痰或少量咯血，最大可能是
A. 肺炎
B. 肺脓肿
C. 肺气肿
D. 肺癌
E. 肺梗死

正确答案：D。肺癌

解析：本例患者为中年男性，有间歇或持续性痰中带血、少量咯血病史，故诊断最可能是肺癌（D对）。肺炎（A错）患者主要表现为胸痛、咳嗽、咳痰，一般不会有咳血痰和咯血。肺脓肿（B错）患者主要表现为高热、咳嗽和咳大量脓臭痰。肺气肿（C错）患者主要表现为胸闷、咳嗽、咳痰，无咯血。肺梗死（E错）患者主要表现为不明原因的呼吸困难及气促、胸痛、晕厥、烦躁不安，甚至有濒死感。